肺外结核病最常引起的形态改变是
A. 直肠息肉形成
B. 脾脏白色锥形病灶
C. 回盲部肠腔狭窄
D. 胃壁溃疡形成
E. 肝脏肿大

正确答案：C。回盲部肠腔狭窄

解析：肺外结核病包括肠结核病、结核性腹膜炎、结核性脑膜炎、泌尿生殖系统结核病、骨与关节结核病以及淋巴结结核病。其中，以肠结核病最为常见。肠结核分为溃疡型和增生型，溃疡型多见，溃殇愈合后由于瘢痕形成和纤维收缩可导致回盲部肠腔狭窄（C对）；增生型黏膜面可有息肉形成，但增生型少见，且肠结核大多（约85%）发生于回盲部，故直肠息肉形成（A错）少见。肺外结核病通常不发生在胃、肝脏和脾脏（BDE错）。